一患者戴用全口义齿一周，主诉咀嚼费力，黏膜压痛，面部酸胀。处理方法是
A. 坚持戴用，逐渐适应
B. 调（牙合）
C. 基托组织面缓冲
D. 重新制作
E. 重衬

正确答案：D。重新制作

解析：本题考查戴用义齿后可能出现的问题及处理。患者主诉咀嚼费力，黏膜压痛，面部酸胀，这种情况多是由于全口义齿垂直距离恢复过高导致的，垂直距离过高时应当重新排列下颌后牙降低垂直距离，或重新制作义齿（D对）。坚持戴用（A错），会导致咀嚼功能下降，黏膜压痛并有可能出现黏膜疾病，面部肌肉持续酸痛，长时间会出现肌肉肌力下降，颞下颌关节疾病等。调（牙合）（B错）可以解决义齿颌位关系不正确的问题，不能正确恢复义齿的垂直距离。基托组织面缓冲（C错）用于解决牙槽嵴骨尖骨嵴导致黏膜压痛的问题。重衬（E错）用于解决因牙槽骨吸收而导致的义齿固位不良、义齿与黏膜之间不密合的问题，不能解决垂直距离过高的问题。